制定药品包装、标签、说明书印制规定的部门是
A. 市（地）级药品监督管理机构
B. 国家市场监督管理部门
C. 省级药品监督管理部门
D. 省（区、市）市场监督管理部门
E. 国家药品监督管理局

正确答案：E。国家药品监督管理局

解析：本题考查药品包装的管理。制定药品包装、标签、说明书印制规定的部门是国家药品监督管理局（E对）。《中华人民共和国药品管理法实施条例》第六章药品包装的管理第四十三条：药品生产企业使用的直接接触药品的包装材料和容器，必须符合药用要求和保障人体健康、安全的标准。直接接触药品的包装材料和容器的管理办法、产品目录和药用要求与标准，由国务院药品监督管理部门组织制定并公布。第四十四条：生产中药饮片，应当选用与药品性质相适应的包装材料和容器；包装不符合规定的中药饮片，不得销售。中药饮片包装必须印有或者贴有标签。中药饮片的标签必须注明品名、规格、产地、生产企业、产品批号、生产日期，实施批准文号管理的中药饮片还必须注明药品批准文号。第四十五条：药品包装、标签、说明书必须依照《药品管理法》第五十四条和国务院药品监督管理部门的规定印制。药品商品名称应当符合国务院药品监督管理部门的规定。第四十六条：医疗机构配制制剂所使用的直接接触药品的包装材料和容器、制剂的标签和说明书应当符合《药品管理法》第六章和本条例的有关规定，并经省、自治区、直辖市人民政府药品监督管理部门（C错）批准。